患者，男，69岁，患高血压20年，高脂血症10年，冠心病5年。1个月前因急性心肌梗死，于前降支植入一枚药物洗脱支架。关于该患者抗血小板治疗方案的说法，错误的是
A. 双联抗血小板药物可选用阿司匹林+氯吡格雷
B. 双联抗血小板药物可选用阿司匹林+替格瑞洛
C. 双联抗血小板疗程结束后，可长期单用阿司匹林
D. 双联抗血小板疗程结束后，若阿司匹林不耐受，可长期单用替格瑞洛
E. 双联抗血小板疗程结束后，若阿司匹林不耐受，可长期单用氯吡格雷

正确答案：D。双联抗血小板疗程结束后，若阿司匹林不耐受，可长期单用替格瑞洛

解析：本题考查抗血小板治疗方案。抗血小板治疗一般选择阿司匹林，如果阿司匹林不能耐受可以选择氯吡格雷，目前没有证据支持可以长期单用替格瑞洛抗血小板治疗（D错，为本题正确答案）。稳定型冠心病患者如果行冠状动脉介入治疗，植入药物洗脱支架，暴露在血管内壁的支架能够激活血小板形成血栓，故发生支架内血栓的风险极大，需进行阿司匹林（100mg qd）+氯吡格雷（75mg qd）（A对）或替格瑞洛（90mg bid）（B对）的双联抗血小板治疗至少持续12个月，待药物洗脱支架被完全内皮化；此后的抗血小板治疗一般选择阿司匹林（C对），如果阿司匹林不能耐受可以选择氯吡格雷（E对）。